汞蒸气具有
A. 高度的弥散性和脂溶性
B. 高度的弥散性和水溶性
C. 脂溶性和水溶性
D. 低度的弥散性和脂溶性
E. 低度的弥散性和高度水溶性

正确答案：A。高度的弥散性和脂溶性

解析：本题考查汞的理化性质。金属汞主要以蒸气形式经呼吸道进入体内。汞蒸气具有高脂溶性，可迅速弥散（A对BCDE错），透过肺泡壁被吸收，吸收率可高达85%。汞也可经皮肤吸收，但难经消化道吸收。